自然课上，老师总是先讲一个故事，然后提出问题，这种教学方式正好符合大脑皮层的
A. 始动调节
B. 动力定型
C. 优势法则
D. 保护性抑制
E. 镶嵌式活动

正确答案：C。优势法则